属于宫颈癌初筛方法的是
A. B型超声波检查
B. 宫颈活组织病理学检查
C. 阴道分泌物常规化验
D. 宫颈细胞检查
E. 阴道镜检查

正确答案：D。宫颈细胞检查

解析：本题考查宫颈癌初筛方法。宫颈细胞学检查（D对ABCE错）是筛查宫颈癌的方法。细胞学检查特异型性高，但敏感性较低，可与人乳头瘤病毒（HPV）DNA检测方法联合使用。